阿片受体的特异性拮抗药是
A. 纳洛酮
B. 美沙酮
C. 芬太尼
D. 吗啡
E. 烯丙吗啡

正确答案：A。纳洛酮

解析：阿片受体的拮抗药有纳洛酮、纳曲酮。纳洛酮化学结构与吗啡相似，为阿片受体完全拮抗药（A对）。